更容易转变为恶性黑色素瘤的是
A. 交界痣
B. 复合痣
C. 皮内痣
D. 毛痣
E. 雀斑样色素痣

正确答案：A。交界痣

解析：恶性黑色素瘤多来自交界痣。掌握“色素痣”知识点。